在药品质量标准性状项下，未收载比旋度要求的药物是
A. 对氨基水杨酸钠
B. 肾上腺素
C. 葡萄糖
D. 蔗糖
E. 乳糖

正确答案：A。对氨基水杨酸钠